维生素C的化学名是
A. L（+）-苏阿糖型-2，3，4，5，6-五羟基-2-己烯酸-4-内酯
B. L（-）-苏阿糖型-2，3，4，5，6-五羟基-2-己烯酸-4-内酯
C. D（-）-苏阿糖型-2，3，4，5，6-五羟基-2-己烯酸-4-内酯
D. D（+）-苏阿糖型-2，3，4，5，6-五羟基-2-己烯酸-4-内酯
E. L（±）-苏阿糖型-2，3，4，5，6-五羟基-2-己烯酸-4-内酯

正确答案：A。L（+）-苏阿糖型-2，3，4，5，6-五羟基-2-己烯酸-4-内酯